空气质量指数（AQI）的数值可以反映空气质量状况，其中代表了重度污染的是
A. 51～100
B. 101～200
C. 201～300
D. 301～400
E. ＞400

正确答案：C。201～300

解析：本题考查空气质量指数的相关内容。空气质量指数（AQI）的数值可以反映空气质量状况，其中代表了重度污染的是201～300（C对ABDE错）。